塑料制品燃烧时所产生的具有强烈致癌作用的物质是
A. TCDD
B. PCDD
C. DDT
D. 二噁英
E. 双酚A

正确答案：D。二噁英

解析：本题考查塑料制品燃烧时所产生的具有强烈致癌作用的物质。塑料制品燃烧时会产生大量的环境毒物如二噁英（D对ABCE错），具有强烈的致癌作用。